易引起第二乳磨牙滞留的是
A. 新生牙
B. 多生牙
C. 弯曲牙根
D. 先天性缺牙
E. 融合牙

正确答案：D。先天性缺牙

解析：本题考查乳牙滞留。易引起第二乳磨牙滞留的是先天性缺牙（D对）。乳牙滞留是指继承恒牙已萌出，未能按时脱落的乳牙，或恒牙未萌保留在恒牙列中的乳牙。最常见的是下颌乳中切牙滞留，其次常见的是第一乳磨牙的残根和残冠滞留于萌出的第一前磨牙颊侧或舌侧。第二乳磨牙滞留多因继承恒牙牙胚的先天缺失或埋伏阻生。但由于乳牙未能按时脱落，又常常使继承恒牙萌出受阻或异位萌出。新生牙（A错）：是指出生后30天内萌出的牙齿，应与上皮珠进行鉴别。多生牙（B错）：也称额外牙，是人类正常牙列以外发生的牙齿，可位于颌骨的任何部位，可萌出于口腔内，也可埋伏于颌骨内。弯曲牙（C错）：是牙冠和牙根形成一定弯曲角度的牙齿，多指的是前牙弯曲。融合牙（E错）：是由两个正常牙胚的牙釉质或牙本质融合在一起而成，极少数情况可出现两个以上牙胚融合。